胆固醇的生物合成途径如下：阿托伐他汀通过抑制羟甲戊二酰辅酶A还原酶产生降血脂作用。阿托伐他汀抑制该酶活性的必需药效团是
A. 异丙基
B. 吡咯环
C. 氟苯基
D. 3，5-二羟基戊酸结构片段
E. 酰苯胺基

正确答案：D。3，5-二羟基戊酸结构片段

解析：本题考查药物结构与官能团。阿托伐他汀通过抑制羟甲戊二酰辅酶A还原酶产生降血脂作用活性的必需药效团是有3， 5-二羟基羧酸（D对）。药物是由一个核心的主要骨架结构（母核起连接作用）和与之相连接的基团或片段（又称药效团作用是与靶标结合）组成。阿托伐他汀的母核是吡咯环（B错），含有3， 5-二羟基羧酸的结构片段，为其药效团。